下列哪项不是闭经与痛经的共同病机
A. 气血虚弱
B. 气滞血瘀
C. 肺肾阴虚.
D. 肝肾不足
E. 寒凝血瘀

正确答案：C。肺肾阴虚.

解析：肺肾阴虚证，指肺肾阴液亏虚，虚热内扰，以干咳、少痰、腰酸、遗精等为主要表现的虚热证候。若火扰精室则遗精，阴血亏虚而经少，虚火损及阴络则崩漏。不会导致闭经或痛经（C对）。素体气血不足或思虑、饮食损伤脾胃，生化不足，营血亏虚，无血可下而闭经；气血虚弱，不能濡养冲任、子宫，兼之气虚无力流通血气，发为痛经（A错）。素体抑郁或恚怒伤肝，气郁不舒，血行失畅，瘀阻子宫、冲任。“不通则痛”，分为痛经;七情所伤，肝失疏泄，气行则血行，气结则血瘀，瘀血阻于脉道。或经行之际，感受寒邪，血受寒则凝，瘀阻冲任，血不得下，血海不能满溢而致闭经（B错）。先天不足、精气未充、天癸亏乏不能应时泌至则冲任不盛、任脉不通而闭经；先天不足，精血不足，或经后血海空虚，冲任、子宫失于濡养，不荣则痛，发为痛经（D错）。感受寒邪，血受寒而凝，瘀阻冲任，血不得下，血海不能满溢而致闭经；感受寒邪，或过食寒凉生冷，寒客冲任，与血相搏，以致子宫、冲任气血不畅，不通则痛，发为痛经（E错）。